遵循“道德原则”的是
A. 本我
B. 自我
C. 超我
D. 无我
E. 忘我

正确答案：C。超我

解析：“超我”代表良心或道德力量的人格结构部分，“超我”的活动遵循“道德原则”。掌握“心理治疗的理论基础”知识点。